某男，52岁。肥胖，嗜好烟酒。胁肋重着疼痛，口苦口黏，胸闷纳呆，小便色黄，大便不爽；舌红苔黄腻，脉弦滑数。超声检查结果提示中度脂肪肝。血液检验结果：总胆固醇8.2mmol/L，三酰甘油（甘油三酯）3.5mmol/L，高密度0.45mmol/L，低密度脂蛋白7.1mmol/L，血清总蛋白55g/L。中医诊断为胁痛，证属肝胆湿热，宜选用的基础方剂是
A. 柴胡疏肝散
B. 血府逐瘀汤
C. 一贯煎
D. 龙胆泻肝汤
E. 逍遥散

正确答案：D。龙胆泻肝汤

解析：本题考查的是胁痛的辨证论治。某男，52岁。肥胖，嗜好烟酒。胁肋重着疼痛，口苦口黏，胸闷纳呆，小便色黄，大便不爽；舌红苔黄腻，脉弦滑数。超声检查结果提示中度脂肪肝。血液检验结果：总胆固醇8.2mmol/L，三酰甘油（甘油三酯）3.5mmol/L，高密度0.45mmol/L，低密度脂蛋白7.1mmol/L，血清总蛋白55g/L。中医诊断为胁痛，证属肝胆湿热，宜选用的基础方剂是龙胆泻肝汤（D对）。胁痛是指以一侧或两侧胁肋部疼痛为主要表现的疾病。西医学中急慢性肝炎、胆囊炎、胆石症、肋间神经痛等以胁痛为主要表现者均可参考此内容辨证论治。（一）肝郁气滞证：【方剂应用】基础方剂为柴胡疏肝散（柴胡、香附、枳壳、芍药、陈皮、川芎、炙甘草）加减（A错）。（二）肝胆湿热证：【方剂应用】基础方剂为龙胆泻肝汤（龙胆、泽泻、木通、车前子、当归、柴胡、生地黄、黄芩、栀子、生甘草）加减。（三）瘀血阻络证：【方剂应用】基础方剂为血府逐瘀汤（当归、生地黄、桃仁、红花、枳壳、赤芍、柴胡、川芎、桔梗、牛膝、甘草）或复元活血汤（柴胡、栝楼根、当归、红花、甘草、穿山甲、大黄、桃仁）加减（B错）。（四）肝络失养证：【方剂应用】基础方剂为一贯煎（北沙参、麦冬、当归、生地黄、枸杞子、川楝子）（C错）。积聚肝气郁结证：【方剂应用】基础方剂为逍遥散（柴胡、白术、白芍、当归、茯苓、甘草、薄荷、煨姜）合木香顺气散（木香、香附、槟榔、青皮、陈皮、厚朴、苍术、枳壳、砂仁、生姜、甘草）加减（E错）。